女，55岁，阴道少量流血1月余，妇科检查：宫颈糜烂样，触血（+），宫体正常大小，双侧附件正常。宫颈细胞学检查结果为HSIL，HPV33（+）。进一步的处理是
A. 宫颈活组织检查
B. 全子宫切除术
C. 广泛性全子宫切除术
D. 广泛性子宫切除+盆腔淋巴结切除术
E. 宫颈锥形切除术

正确答案：A。宫颈活组织检查

解析：中老年女性（宫颈癌的高发年龄），阴道少量接触性流血，妇科检查：宫颈糜烂样，宫体正常大小。宫颈细胞学检查结果为HSIL（高级别鳞状上皮内病变），HPV33（+）(高危型）。高度怀疑宫颈癌，该病早期诊断应采用子宫颈细胞学检查和（或）HPV检测、阴道镜检查、子宫颈活组织检查（A对）的“ 三阶梯”程序，结合本题，进一步处理为宫颈活组织检查（A对）。若行宫颈活组织检查仍不能除外浸润癌者、或活检为可疑微小浸润癌需要测量肿瘤范围或除外进展期浸润癌者，需行子宫颈锥切术（E错）。全子宫切除术（B错）、广泛子宫切除术（C错）及广泛子宫切除术+盆腔淋巴结切除术（D错）为确诊宫颈癌后，适用于早期（ⅠA～ⅡA期）的基本治疗措施，其优点在于可保留年轻患者卵巢及阴道功能。